哪项不是危险管理的要素
A. 危险度评定
B. 危险-效益评价
C. 扩散和暴露控制
D. 危险估计
E. 危险度监测

正确答案：D。危险估计